男，54岁。胸痛3天，深吸气时明显，屏气时消失。胸痛最可能的原因是病变累及
A. 心包
B. 食管
C. 肺尖
D. 胸膜
E. 主动脉

正确答案：D。胸膜

解析：中年男性患者，胸痛呈现深吸气时明显而屏气时消失的特点，与胸膜炎的胸痛性质相符，故最可能的原因是病变累及胸膜（D对）。心包（A错）、食管（B错）疾病、肺尖（C错）和主动脉（E错）等引起的胸痛均不会出现屏气时消失的现象。